斜面裂形成的原因是
A. 中鼻突与侧鼻突未联合或联合不全
B. 侧鼻突与上颌突未联合或联合不全
C. 中鼻突与上颌突未联合或联合不全
D. 上颌突与下颌突未联合或联合不全
E. 上颌突与球状突未联合或联合不全

正确答案：B。侧鼻突与上颌突未联合或联合不全

解析：面裂：上下颌突未联合或部分联合，发生横面裂，裂隙可自口角至耳屏前。如为部分联合则形成大口畸形；如联合过多则形成小口畸形。如上颌突与侧鼻突未联合则形成斜面裂。裂隙由上唇沿着鼻翼基部至眼睑下缘。掌握“面部的发育”知识点。